教学用房的外墙与铁路的距离不应小于
A. 50m
B. 80m
C. 100m
D. 200m
E. 300m

正确答案：E。300m